低分化涎腺粘液表皮样癌与鳞状细胞癌的鉴别要点是
A. 表皮样细胞
B. 粘液细胞
C. 中间细胞
D. 鳞状化生
E. 未分化细胞

正确答案：B。粘液细胞

解析：低分化涎腺黏液表皮样癌：构成细胞主要是中间细胞和表皮样细胞，粘液细胞较少，低于10%，散在于表皮样细胞之间，肿瘤细胞异型性及核分裂象明显，排列成片或实性上皮团，缺乏囊腔和腺腔结构，向周围组织呈浸润性增殖，有时易误诊为鳞状细胞癌，用黏液染色证明含少数的粘液细胞即可诊断。掌握“黏液表皮样癌”知识点。